某男，65岁，吸烟10余年，近2年来出现气喘，呼吸困难，咳嗽咯痰，胸部视诊见胸廓前后径增大，肋间隙增宽，两肺听诊呼吸音减弱，呼气延长。其诊断是
A. 支气管肺癌
B. 支气管哮喘
C. 支气管扩张
D. 慢性阻塞性肺疾病
E. 肺结核

正确答案：D。慢性阻塞性肺疾病

解析：患者有10年吸烟史，两年间反复出现气喘呼吸困难的症状，且复合慢性阻塞性肺疾病胸廓前后径增大，肋间隙增宽，呼气延长体征，故可诊断为慢性阻塞性肺疾病（D对）。肺癌的临床表现比较复杂，症状和体征的有无、轻重以及出现的早晚，取决于肿瘤发生部位、病理类型、有无转移及有无并发症，以及患者的反应程度和耐受性的差异。肺癌早期症状常较轻微，甚至可无任何不适。中央型肺癌症状出现早且重，周围型肺癌症状出现晚且较轻，甚至无症状，常在体检时被发现。肺癌的症状大致分为：局部症状、全身症状、肺外症状、浸润和转移症状（A错）。哮喘，是种多因素的异质性疾病，常以慢性气道炎症为特征；既往有喘息、气短、胸闷和咳嗽等呼吸道症状并随时间和强度改变，并伴有可逆性气流受限（B错）。支气管扩张症是由于支气管及其周围肺组织慢性化脓性炎症和纤维化，使支气管壁的肌肉和弹性组织破坏，导致支气管变形及持久扩张。典型的症状有慢性咳嗽、咳大量脓痰和反复咯血（C错）。肺结核多呈慢性过程，以低热、盗汗、消瘦、乏力、食欲不振等全身中毒症状及咳嗽、咳痰、咯血、呼吸困难、胸痛等呼吸系统症状为主要表现（E错）。